吸收入血的砷化物与下列哪种物质结合能力较强
A. 羟基
B. 甲基
C. 巯基
D. 二甲基
E. 羧基

正确答案：C。巯基

解析：本题考查与吸收入血的砷化物结合能力较强的物质。砷吸收入血后首先在血液中聚集，其中95%的三氧化二砷、砷酸盐、亚砷酸盐与血红蛋白中的珠蛋白结合，然后被运输至肝、肾、脾、肺、脑、皮肤及骨骼中。砷在体内有较强的蓄积性，吸收入血的三价砷与巯基（C对ABDE错）结合能力较强，并于吸收后24小时内分布于富含巯基的组织器官，例如肝、肾、脑等实质性脏器。